药材质地显粉性，表明其富含
A. 石细胞
B. 淀粉
C. 草酸钙结晶
D. 菊糖
E. 碳酸钙结晶

正确答案：B。淀粉

解析：本题考查的是药材的质地。药材质地显粉性，表明其富含淀粉（B对）。质地：指药材的轻重、软硬、坚实、坚韧、疏松（或松泡）、致密、黏性、粉性、纤维性、绵性、角质性、油润性等特征。这与组织结构、细胞中所含的成分及加工方法等有一定的关系。以薄壁组织为主，结构较疏松的药材一般较脆或较松泡，如南沙参、生晒参等；富含淀粉的显粉性，如山药、半夏等；含纤维多的则韧性强，如桑白皮、葛根等；含糖、黏液多的一般黏性大，如黄精、地黄等；富含淀粉、多糖成分的经蒸、煮糊化干燥后常质地坚实，半透明，呈角质状，如红参、延胡索、天麻等。